对心肌缺血与心内膜下梗死的鉴别，最有意义的是
A. 淀粉酶
B. 血清转氨酶
C. γ-谷氨酰基转肽酶
D. 肌酸磷酸激酶
E. 血清碱性磷酸酶

正确答案：D。肌酸磷酸激酶

解析：对心肌缺血与心内膜下梗死的鉴别，最有意义的是肌酸磷酸激酶（D对），肌酸磷酸激酶有3种同工酶，其中CK-MB来自心肌，其诊断敏感度和特异度均极高，分别达到100%和99%，故肌酸磷酸激酶升高的幅度和持续的时间常用于判定梗死的范围和严重性；而心肌缺血时，肌酸磷酸激酶常不升高。淀粉酶（A错）主要用于急性胰腺炎等的诊断。血清转氨酶（B错）主要用于病毒性肝炎等的诊断。γ-谷氨酰基转肽酶（C错）在急性肝炎、慢性活动性肝炎及肝硬化失代偿期时轻度升高。血清碱性磷酸酶（E错）在骨肉瘤时升高。